PSI中污染物种类包括
A. 颗粒物质和NO₂
B. NO₂和SO₂
C. CO和O₃
D. 颗粒物质和O₃
E. 颗粒物质和SO₂

正确答案：E。颗粒物质和SO₂

解析：本题考查PSI中污染物种类。PSI即污染物标准指数，是用于评价大气质量逐日变化的大气质量指数。PSI中污染物种类包括颗粒物质和SO₂（E对ABCD错）。